女性尿道的描述,正确的是
A. 约长8~10cm
B. 位于阴道下半的后面
C. 尿道旁腺感染时，可形成囊肿而致尿路阻塞
D. 尿道下端有尿道阴道括约肌环绕，不受意志支配
E. 较男性尿道短而宽,且较直,不易患逆行性尿路感染

正确答案：C。尿道旁腺感染时，可形成囊肿而致尿路阻塞

解析：女性尿道平均长 3 -5cm（A错）, 较男性尿道短、宽而直（E错）,故易患逆行性尿路感染。尿道外口位于阴道口的前方，说明女性尿道位于阴道的前方（B错）。尿道阴道括约肌为横纹肌，横纹肌为随意肌，受意志支配（D错），不受意志支配的是平滑肌膀胱括约肌。尿道旁腺感染时，可形成囊肿而压迫尿道（C对）。